温邪上受，首先侵犯的脏腑是
A. 脾
B. 胃
C. 肺
D. 肝
E. 心

正确答案：C。肺

解析：温病的病因是“温邪”，其侵入人体的途径多为“上受”，首发病位是肺卫（C对），如及时正确地诊治，病邪即可外解，可谓不传。若邪不外解，肺卫之邪将进一步深入。